抗肿瘤药的分类不包括
A. 干扰核酸合成
B. 干扰蛋白质合成
C. 影响激素平衡而抑制肿瘤
D. 破坏DNA结构与功能
E. 抗生素类

正确答案：E。抗生素类

解析：抗肿瘤药的分类包括：干扰核酸合成、破坏DNA结构与功能、嵌入DNA及干扰转录过程而组织RNA合成、干扰蛋白质合成、影响激素平衡而抑制肿瘤。掌握“抗恶性肿瘤药”知识点。